女性，20岁。颌面部跌伤4小时。无昏迷史，脉搏、血压、呼吸均正常。口腔检查：上唇有一个2cm长的穿通伤口，上2-2牙龈撕裂，轻摇之有骨块异常活动。下颌检查未见异常。后牙咬合关系正常，张口未受限。为明确诊断，还应做的辅助检查是
A. 不需再加做辅助检查
B. 患者咬压舌板检查
C. 摩擦音检查
D. 拍摄上颌咬合片
E. 触摸上颌骨有无骨折线

正确答案：D。拍摄上颌咬合片

解析：本题考查颌骨骨折的诊断。颌骨骨折一般通过X线平片了解骨折情况，可确诊（D对）。咬合错乱是颌骨骨折最重要的骨折体征。通过触摸检查，以手指或器械捏住上颌前牙，摇动上颌骨有无浮动感等（E错）。